女，28岁。恶心、呕吐、乏力、头晕1周。近2个月体重减低，皮肤变黑，查体：BP90/60mmHg，心率84次/分，立位BP75/50mmHg，心率99次/分，身高169cm，体重50Kg，皮肤黑，甲状腺Ⅰ度肿大。心、肺、腹未见异常。实验室检查：血钠124mmol/L，血钾5.8mmol/L，血糖3.5mmol/L。该患者最可能的诊断是
A. 甲状腺功能减退
B. 垂体卒中
C. 原发性慢性肾上腺皮质功能减退症
D. 慢性肾衰竭
E. 真菌感染

正确答案：C。原发性慢性肾上腺皮质功能减退症

解析：青年女性患者，出现恶心、呕吐、乏力、头晕，血压偏低、直立性低血压（BP90/60mmHg，立位BP 75/50 mmHg）；体型偏瘦（身高169cm，体重50Kg），皮肤黑，甲状腺Ⅰ度肿大（原发性慢性肾上腺皮质功能减退症的典型临床表现）。实验室检查见电解质紊乱：低血钠（正常值135～145mmol/L），高血钾（正常值3.5～5.5 mmol/L）。血糖3.5mmol/L偏低（空腹血糖正常值3.9～6.0mmol/L）。该患者最可能的诊断是原发性慢性肾上腺皮质功能减退症（C对）。甲状腺功能减退（P689）（A错）常表现为代谢率减低及交感神经兴奋性下降，常有体重增加而非减轻，且无皮肤色素沉着。垂体卒中（P660）（B错）指垂体瘤突发瘤内出血，引起严重头痛、视力障碍、昏迷等，与本例不符。慢性肾衰竭（D错）多见于中老年人，常有乏力、腰酸、夜尿增多等表现，严重者可有急性左心衰、严重高钾、消化道出血或中枢神经系统症状（P520）。真菌感染（E错）局限于表皮有色泽改变，但一般不会有电解质失衡、血压等全身改变。